健康教育评价的目的在于
A. 确定计划达到预期目标的程度
B. 进一步确定优先项目
C. 进一步确定目标
D. 有助于制定策略
E. 有助于确定研究方法

正确答案：A。确定计划达到预期目标的程度